孟氏（Monteggia）骨折的X线
A. 桡骨干下1/3骨折合并尺骨上1/3骨折
B. 尺骨干上1/3骨折合并下尺桡关节分离
C. 尺骨干上1/3骨折合并桡骨头脱位
D. 尺骨干下1/3骨折合并桡骨头脱位
E. 桡骨干上1/3骨折合并尺骨下1/3骨折

正确答案：C。尺骨干上1/3骨折合并桡骨头脱位

解析：孟氏（Monteggia）骨折的X线表现为尺骨干上1/3骨折合并桡骨头脱位（C对）。桡骨干下1/3骨折合并尺骨小头脱位，称为盖氏（Galeazzi）骨折。